患者输血5分钟后立即出现寒战，高热，头痛，腰背部剧痛，心前区压迫感检查：血压78/60mmHg10.4/8KPa，血浆呈粉红色应首先考虑的诊断是
A. 发热反应
B. 过敏反应
C. 溶血反应
D. 细菌污染反应
E. 以上均非

正确答案：C。溶血反应

解析：因为病人出现寒战，高热、呼吸困难、腰背酸痛、头痛、胸闷、心率加快乃至血压下降、休克，随之出现血红蛋白尿（小便颜色酱油样）和溶血性黄疽，所以首先考虑的诊断是溶血反应（C对E错）。发热反应的临床表现一般为畏寒或寒战、高热，体温可达39℃～41℃。可伴有头痛、汗出、恶心、呕吐、皮肤潮红、心悸、心动过速。反应持续30分钟至2小时后逐渐缓解（A错）。过敏反应轻者仅有皮肤局限性或全身性瘙痒、皮肤红斑、荨麻疹。严重者可出现支气管痉挛、血管神经性水肿、会厌水肿，表现为咳嗽、喘鸣、呼吸困难及腹痛、腹泻、喉头水肿，甚至窒息、过敏性休克、昏迷、死亡（B错）。细菌污染反应临床表现，轻者可仅有发热，重者可立即出现内毒素性体克（如大肠杆菌或绿脓杆菌）和DIC。症见烦躁、寒战、高热、呼吸困难、恶心、呕吐、发绀、腹痛和休克。也可以出现血红蛋白尿、急性肾衰竭、肺水肿，甚至短期内死亡（D错）。